患者在初次服用哌唑嗪时，由于机体对药物作用尚未适应而引起不可耐受的强烈反应，该不良反应是
A. 过敏反应
B. 首剂效应
C. 副作用
D. 后遗效应
E. 特异性反应

正确答案：B。首剂效应

解析：本题考查药品的不良反应。首剂效应（B对）是指一些患者在初服某种药物时，由于机体对药物作用尚未适应而引起不可耐受的强烈反应，例如患者在初次服用哌唑嗪时所出现的强烈反应。过敏反应（E错）是指机体受药物刺激所发生的异常免疫反应，引起机体生理功能障碍或组织损伤。副作用（C错）是指在药物按正常用法用量使用时，出现的与治疗目的无关的不适反应。后遗效应（D错）是指在停药后，血药浓度已降至最小有效浓度以下时残存的药理效应。特异质反应（E错）也称特异性反应，是因先天性遗传异常，少数病人用药后发生与药物本身药理作用无关的有害反应。